关于细菌内毒素的描述，不正确的是
A. 由革兰阴性菌裂解产生
B. 化学成分为脂多糖
C. 毒性较弱且无特异性
D. 耐热，160℃，2~4小时才被破坏
E. 抗原性强，经甲醛处理可制成类毒素

正确答案：E。抗原性强，经甲醛处理可制成类毒素